女孩，1岁。腹泻4天。每日大便10余次，为蛋花汤水样便，伴呕吐、尿少。查体：T38.5℃，前囟、眼窝凹陷，皮肤弹性差，四肢稍凉。实验室检查：血WBC3.6×10⁹/L，血Na⁺127mmol/L，血K⁺3.7mmol/L，BE-15mmol/L。补液过程中，患儿突然惊厥，此时首选的辅助检查是
A. 头颅MRI
B. 血电解质
C. 头颅CT
D. 脑脊液
E. 血糖

正确答案：B。血电解质

解析：女性患儿，腹泻4天。每日大便10余次，为蛋花汤水样便，伴呕吐、尿少。查体：T38.5℃，前囟、眼窝凹陷，皮肤弹性差，四肢稍凉。实验室检查：血WBC3.6×10⁹/L（正常值4.0～10.0×10⁹/L），血Na⁺127mmol/L（正常值135～145mmol/L），血K⁺3.7mmol/L（正常值3.5～5.5mmol/L），BE-15mmol/L（正常值－3～＋3mmol/L）。综合患者的症状、体征和辅助检查，最可能的病原体是轮状病毒所致腹泻病。补液过程中，患儿突然惊厥，此时首选的辅助检查是血电解质（B对）。头颅MRI（A错）、头颅CT（C错）适用于脑血管病变和畸形的诊断。脑脊液（D错）、血糖（E错）适用于感染性疾病的诊断。